前牙缺失可影响的发音是
A. 双唇音
B. 唇齿音
C. 舌尖中音
D. 舌尖后音
E. 舌根音

正确答案：B。唇齿音

解析：前牙缺失对发音功能影响很大，特别是影响齿音、唇齿音、舌齿音的发音，从而影响讲话时的清晰度。掌握“牙列缺损病因及影响”知识点。